十二经脉的交接中，阴经与阳经交接的部位是
A. 腹部
B. 胸部
C. 头部
D. 手足末端
E. 下肢部

正确答案：D。手足末端

解析：十二经脉的循行交接规律是：相互衔接的阴经与阴经在胸腹交接（AB错）；同名的阳经与阳经在头面部（C错）交接；十二经脉的交接中，相为表里的阴经与阳经在手足末端（D对）交接。